患者女，32岁。患风湿性心脏瓣膜病多年，现心悸，盗汗，心烦不寐，两颧发红，干咳，舌红苔少，脉细数。治疗首选
A. 血府逐瘀汤
B. 黄连阿胶汤
C. 生脉散
D. 天王补心丹
E. 保元汤

正确答案：D。天王补心丹

解析：本题患者有风湿性心脏瓣膜病多年，久病体虚，心肾阴虚，虚火内动，扰及心神。肾阴不足，水不济火，不能上济于心，以致心火内动，扰动心神，故心悸而烦，不得安寐。两颧发红，盗汗，舌红苔少，脉细数，均为水亏火亢之征，所以宜用天王补心丹（D对）；血府逐瘀汤宜用于心血瘀阻证，症见心胸疼痛，如刺如绞，痛有定处，入夜为甚，甚则心痛彻背，背痛彻心，或痛引肩背，暴怒或劳累后加重，舌质紫暗，有瘀斑，苔薄，脉弦涩，或结、代（A错）；黄连阿胶汤具有扶阴散热之功效，主治少阴病，心中烦，不得卧或邪火内攻，热伤阴血，下利脓血（B错）；生脉散主治久咳伤肺，气阴两虚证，症见干咳少痰，短气自汗，口干舌燥，脉虚细（C错）；保元汤主治元气虚弱，精神倦怠，肌肉柔软，纳呆，面色㿠白，睡卧宁静，痘顶不起，浆不足，及有杂证。气血不足，婴儿怯弱，痘毒内陷，面色苍白，气陷久泻，肢体无力，肺脾虚弱，恶寒自汗（E错）。